自由度为1的χ²检验是
A. 成组设计四格表资料χ²检验
B. 配对设计四格表资料χ²检验
C. 成组设计四格表资料χ²检验或配对设计四格表资料χ²检验
D. 2行多列的行×列表资料的χ²检验
E. 多行2列的行X列表资料的χ²检验

正确答案：C。成组设计四格表资料χ²检验或配对设计四格表资料χ²检验